《药品注册管理办法》不适用于
A. 药物临床试验申请
B. 药品生产申请
C. 药品进口申请
D. 药品抽查性检验
E. 药品注册监督管理

正确答案：D。药品抽查性检验

解析：本题考查《药品注册管理办法》的适用。《药品注册管理办法》不适用于药品抽查性检验（D错，为本题正确答案）。《药品注册管理办法》第一章总则第二条：在中华人民共和国境内以药品上市为目的，从事药品研制、注册及监督管理活动（ABCE对），适用本办法。